药品经营企业发现或者获知新的、严重（非死亡病例）药品不良反应，应当及时报告，报告的时限是
A. 20日内
B. 10日内
C. 30日内
D. 15日内

正确答案：D。15日内

解析：本题考查的是个例药品不良反应的收集。药品经营企业发现或者获知新的、严重（非死亡病例）药品不良反应，应当及时报告，报告的时限是15日内（D对）。个例药品不良反应的收集：个例药品不良反应的收集和报告是药品不良反应监测工作的基础，也是药品上市许可持有人应履行的基本法律责任。药品上市许可持有人应建立面向医生、药师、患者等的有效信息途径，主动收集临床使用、临床研究、市场项目、学术文献以及药品上市许可持有人相关网站或论坛涉及的不良反应信息。境内发生的严重不良反应应当自严重不良反应发现或获知之日起15日内报告，死亡病例及药品群体不良事件应当立即报告，其他不良反应应当在30日内（C错）报告。药品上市许可持有人应当对严重不良反应报告中缺失的信息进行随访，对死亡病例开展调查并按要求提交调查报告。医疗机构通过药品不良反应监测系统报告发现或获知的药品不良反应，也可向药品上市许可持有人直接报告。药品经营企业直接向药品上市许可持有人报告。药品上市许可持有人不得以任何理由或手段干涉报告者的自发报告行为。